头胸部与前腹部呈扁平长椭圆形，后腹部呈尾状，皱缩弯曲，头胸部呈绿褐色，前面有1对短小的螯肢及1对较长大的钳状脚须，形似蟹螯，后腹部棕黄色，末节有锐钩状毒刺的药材是
A. 桑螵蛸
B. 斑蝥
C. 全蝎
D. 蜈蚣
E. 土鳖虫

正确答案：C。全蝎

解析：本题考查全蝎的性状鉴别。头胸部与前腹部呈扁平长椭圆形，后腹部呈尾状。头胸部绿褐色，前面有1对短小的螯肢及1对较长大的钳状脚须，形似蟹螯；前腹部由7节构成，后腹部6节，节上均有纵沟，末节有锐钩状毒刺的是全蝎（C对）。全蝎【性状鉴别】药材头胸部与前腹部呈扁平长椭圆形，后腹部呈尾状，皱缩弯曲，完整者体长约6cm。头胸部呈绿褐色，前面有1对短小的螯肢及1对较长大的钳状脚须，形似蟹螯，背面覆有梯形背甲，腹面有足4对，均为7节，末端各具2爪钩；前腹部由7节组成，第7节色深，背甲上有5条隆脊线。背面绿褐色，后腹部棕黄色，6节，节上均有纵沟，末节有锐钩状毒刺，毒刺下方无距。气微腥，味咸。以完整、色绿褐、身干、腹中杂质少者为佳。桑螵蛸（A错）【性状鉴别】药材团螵蛸：略呈圆柱形或半球形，由多层膜状薄片叠成，长2.5～4cm，宽2～3cm。表面浅黄褐色，上面带状隆起不明显，底面平坦或有凹沟。体轻，质松而韧，横断面可见外层为海绵状，内层为许多放射状排列的小室，室内各有一细小椭圆形卵，深棕色，有光泽。气微腥，味淡或微咸。斑蝥（B错）【性状鉴别】药材南方大斑蝥：呈长圆形，长1.5～2.5cm，宽0.5～1cm。头及口器向下垂，有较大的复眼及触角各1对，触角多已脱落。背部具革质鞘翅1对，黑色，有3条黄色或棕黄色的横纹；鞘翅下面有棕褐色薄膜状透明的内翅2片。胸腹部乌黑色，胸部有足3对。有特殊的臭气。蜈蚣（D错）【性状鉴别】药材呈扁平长条形，长9～15cm，宽0.5～1cm。由头部和躯干部组成，全体共22个环节。头部暗红色或红褐色，略有光泽，有头板覆盖，头板近圆形，前端稍突出，两侧贴有颚肢1对，前端两侧有触角1对。躯干部第1背板与头板同色，其余20个背板为棕绿色或墨绿色，具光泽，自第4背板至第20背板常有2条纵沟线；腹部淡黄色或棕黄色，皱缩；自第2节起，每体节两侧有步足1对，步足黄色或红褐色，偶有黄白色，呈弯钩形，最末一对步足尾状，故又称尾足，易脱落。质脆，断面有裂隙。气微腥，并有特殊刺鼻的臭气，味辛、微咸。以条大、完整、头红、足红褐腹、腹干瘪者为佳。土鳖虫（E错）【性状鉴别】药材地鳖：呈扁平卵形，长1.3～3cm，宽1.2～2.4cm。前端较窄，后端较宽，背部紫褐色，具光泽，无翅。前胸背板较发达，盖住头部；腹背板9节，呈覆瓦状排列。腹面红棕色，头部较小，有丝状触角1对，常脱落，胸部有足3对，具细毛和刺。腹部有横环节。质松脆，易碎。气腥臭，味微咸。